《疫苗流通和预防接种管理条例》实施日期
A. 2005年6月1日
B. 2006年6月1日
C. 2007年6月1日
D. 2008年6月1日
E. 2009年6月1日

正确答案：A。2005年6月1日